肠上皮细胞由肠腔吸收葡萄糖的过程属于
A. 单纯扩散
B. 易化扩散
C. 主动转运
D. 出胞
E. 入胞

正确答案：C。主动转运

解析：肠上皮细胞从肠腔吸收葡萄糖就是一种耗能过程,因上皮细胞内葡萄糖的浓度可超过肠腔中数倍以上,这种逆浓度差耗能的转运属于主动转运。